双侧收缩使头后仰的
A. 胸锁乳突肌
B. 二腹肌
C. 前斜角肌
D. 肩胛舌骨肌
E. 颈阔肌

正确答案：A。胸锁乳突肌

解析：胸锁乳突肌（A对）一侧收缩使头向同侧倾斜，两侧收缩使头后仰。二腹肌（B错）上提舌骨，可使舌升高；当舌骨固定时，可张口。前斜角肌（C错）两侧同时收缩使颈前屈，上提第1、2肋助吸气。肩胛舌骨肌（D错）下降舌骨和喉。颈阔肌（E错）收缩时拉口角及下颌向下，并使颈部皮肤出现皱褶。